外渗性黏液囊肿占黏液囊肿
A. 0.5
B. 0.6
C. 0.7
D. 0.8
E. 0.9

正确答案：D。0.8

解析：外渗性黏液囊肿占黏液囊肿的80%以上，组织学表现为黏液性肉芽肿或充满黏液的假囊，无上皮衬里。外渗性黏液囊肿多是由创伤引起的。掌握“舌下腺及唾液腺黏液囊肿”知识点。